治疗肾阴虚之不孕症，应首选
A. 毓麟珠
B. 养精种玉汤
C. 开郁种玉汤
D. 启宫丸
E. 开郁二陈汤

正确答案：B。养精种玉汤

解析：肾阴虚证治疗要滋肾养血，调补冲任，故用养精种玉汤，不特补血，纯于填精，精满则子宫易于摄精，血足则子宫易于容物（B对）。肾阳虚之不孕证治疗是要温肾暖宫，调补冲任，故用温胞饮或右归丸。毓麟珠功效补肾益气，温养冲任，多用于不孕肾气虚证（A错）。开郁种玉汤功效疏肝解郁，理血调经，多用于不孕肝气郁结证（C错）。启宫丸功效燥湿化痰，行滞调经，多用于不孕痰湿阻滞证（D错）。开郁二陈汤功效开郁行滞，多用于气滞经闭证（E错）。